下列止血药中，可用于须发早白的是
A. 白茅根
B. 苎麻根
C. 侧柏叶
D. 茜草
E. 蒲黄

正确答案：C。侧柏叶

解析：侧柏叶的功效是凉血止血，化痰止咳，生发乌发（D对）。白茅根的功效是凉血止血，清热利尿，清肺胃热而不具有生发乌发治疗须发早白的功效（A错）。苎麻根的功效是凉血止血，安胎，清热解毒而不具有生发乌发治疗须发早白的功效（Ｂ错）。茜草的功效是凉血化瘀止血，通经而不具有生发乌发治疗须发早白的功效（Ｃ错）。蒲黄的功效是止血，化瘀，利尿而不具有生发乌发治疗须发早白的功效（Ｅ错）侧柏叶寒凉入血而祛风，有生发乌发的疗效。